多柔比星导致的充血性心力衰竭可选用
A. 右雷佐生
B. 奥美拉唑
C. 雷尼替丁
D. 维生素B₆
E. 维生素K₁

正确答案：A。右雷佐生

解析：本题考查药物相互作用。多柔比星与右雷佐生（A对）相互作用可对抗心脏毒性。